阳水证的临床表现除去下列哪项
A. 起病急，病程短
B. 肢冷，腰痠痛
C. 水肿先从头面肿起
D. 上半身肿甚
E. 水肿皮薄光亮

正确答案：B。肢冷，腰痠痛

解析：水停证临床又有阳水、阴水之分，水肿性质属实，多表现为阳水；水肿性质属虚，多表现为阴水。阳水皮肤颜色光亮而薄（E对），阴水皮肤颜色萎黄或灰黯无泽。阳水多发病急，来势猛，病程短（A对），眼睑头面先肿（C对），上半身肿甚（D对）；阴水多发病缓，来势徐，水肿先起于足部，腰以下肿甚。房劳伤肾，或病久正气亏虚，致脾肾阳气亏虚可导致水停证，脾肾阳气亏虚故见腰酸肢冷（B错，为本题正确答案）。